患者，男，50岁，主诉咳嗽、咳白痰3天，查体：体温36.9℃，呼吸20次/min，不吸氧的情况下，指氧饱和度为98%。血常规正常，经胸部X线检查，诊断为急性支气管炎。该患者宜选用的药物是
A. 莫西沙星
B. 氨溴索
C. 阿莫西林
D. 阿奇霉素
E. 利巴韦林

正确答案：B。氨溴索

解析：本题考查急性支气管炎治疗常用药物。该患者宜选用的药物是氨溴索（B对）。急性支气管炎通常是对症和支持疗法，包括镇咳药（右美沙芬）、祛痰药（愈创木酚甘油醚、氨溴索）、第一代抗组胺药（苯海拉明）、减充血药（伪麻黄碱）、β受体激动剂（沙丁胺醇）等。患者血常规正常，无感染症状，不适宜选用抗菌药物。莫西沙星（A错）、阿莫西林（C错）、阿奇霉素（D错）均为抗菌药物。利巴韦林（E错）为抗病毒药。